患者，男，65岁，服用依那普利降压治疗，向药师咨询用药，关于血压类型和服药时间的说法，正确的有
A. 血压类型为杓型血压，应于清晨服药
B. 血压类型为杓型血压，应于晚上睡前服药
C. 血压类型为非杓型血压，应于晚上睡前服药
D. 血压类型为非杓型血压，应于清晨服药
E. 抗高血压药均应于清晨服药

正确答案：A、C。血压类型为杓型血压，应于清晨服药；血压类型为非杓型血压，应于晚上睡前服药

解析：本题考查依那普利服用的适宜时间。服用依那普利降压治疗，血压类型为杓型血压，应于清晨服药（A对）。血压类型为非杓型血压，应于晚上睡前服药（C对）。依那普利属钙通道阻滞剂，晚上服用可更有效地降低夜间平均血压，进而有助于非杓型血压向杓型血压的转化。抗高血压药氨氯地平、依那普利、氯沙坦等宜于清晨服用，可有效控制杓型血压。